流感病毒主要侵犯
A. 肠黏膜上皮细胞
B. 肠黏膜上皮细胞外
C. 呼吸道黏膜上皮细胞
D. 神经组织
E. 肺组织

正确答案：C。呼吸道黏膜上皮细胞

解析：病毒在细胞内复制致细胞病变是流感发病的主要机制。流感病毒进人呼吸道后，NA破坏神经氨酸，使纤毛柱状上皮细胞表面的黏蛋白水解，HA受体暴露（C对）。诺如病毒主要侵犯肠黏膜上皮细胞（A错）。狂犬病毒主要侵犯神经组织（D错）。SARS-CoV侵犯肺组织细胞（E错）。